肩关节脱位的主要体征是
A. “4”试验阳性
B. 伸肌腱牵拉试验（Mills征）阳性
C. 杜加（Dugas）征阳性
D. 直腿抬高试验（Lasegue）阳性
E. 压头试验阳性

正确答案：C。杜加（Dugas）征阳性

解析：肩关节脱位的典型表现为方肩畸形、肩胛盂处空虚感、上肢弹性固定及杜加（Dugas）征呈阳性（C对）。“4”试验（A错）是主要见于骶髂关节病变，腰椎间盘突出症，股骨头坏死，强直性脊柱炎，及膝关节疾病等。肌腱牵拉试验（Mills征）（P719）（B错）阳性见于肱骨外上髁炎。直腿抬高试验（Lasegue）（P733）（D错）阳性主要见于腰椎间盘突出症、急性腰扭伤。压头试验（P726）（E错）阳性见于神经根型颈椎病。